治疗肺痨气阴耗伤的最佳选方是
A. 保真汤
B. 百合固金丸
C. 月华丸
D. 补天大造丸
E. 补肺阿胶汤

正确答案：A。保真汤

解析：气阴耗伤证之肺痨是由阴伤气耗，肺脾两虚，肺气不清，脾虚不健所导致的，治疗应该用益气养阴的保真汤或参苓白术散（A对）。百合固金丸滋养肺胃，为虚火灼肺证之肺痨的代表方（B错）。月华丸滋阴润肺，为肺阴亏损证之肺痨的代表方（C错）。补天大造丸滋阴补阳，为阴阳虚损证之肺痨的代表方（D错）。补肺阿胶汤养阴补肺，清热止血，用于小儿肺虚有热证（E错）。